下列各项，不属于涩脉临床主病的是
A. 气滞
B. 血瘀
C. 精伤
D. 血少
E. 热盛

正确答案：E。热盛

解析：数脉是热证的主脉（E错，为本题正确答案）。热盛，正气不衰，邪正相争，邪热燔灼气血而运行加速，所以脉数而有力。涩脉是指形细而行迟，往来艰涩不畅，脉势不匀的脉象。气滞（A对）、血瘀（B对）、痰浊、宿食等邪气内停，脉道受阻，气机不利，血行不畅，所以脉搏往来艰涩，又因实邪内盛，但正气未衰，所以脉涩而有力；精亏（C对）血少（D对），津液耗伤，脉道不能充养，脉失濡润，气血运行不畅，以致脉气往来艰涩而无力。